急性（）中毒后在恢复过程可出现“假愈期”
A. 一氧化碳
B. 氰化氢
C. 硫化氢
D. 有机磷农药

正确答案：A。一氧化碳

解析：本题考查急性CO中毒迟发脑病。急性CO中毒（A对BCD错）迟发脑病是指少数急性CO中毒意识障碍恢复后，经过2～60天的“假愈期”，又出现严重的神经精神和意识障碍症状。重者生活不能自理甚至死亡。头颅CT检查可见脑部病理性密度减低区；脑电图可见中、高度异常。